湿疹患者的实验室检查结果常会出现
A. 中性粒细胞减少
B. 淋巴细胞增多
C. 嗜酸性粒细胞增多
D. 淋巴细胞减少
E. 红细胞增多

正确答案：C。嗜酸性粒细胞增多

解析：本题考查实验室检查结果。湿疹患者的实验室检查结果常会出现嗜酸性粒细胞增多（C对）。湿疹、牛皮癣、疱疹样皮炎、真菌性皮肤病、钩虫病、丝虫病、血吸虫病等皮肤病常见嗜酸性粒细胞增多。中性粒细胞减少（A错）是维生素B₁₂或叶酸缺乏的巨幼细胞贫血的常见与早期表现。淋巴细胞增多（B错）主要见于病毒感染，如传染性淋巴细胞增多症、结核病、水痘、麻疹、风疹、流行性腮腺炎，也可见于百日咳杆菌、布鲁菌等感染。淋巴细胞减少（D错）多见于免疫缺陷病、接触放射线等。高山地区居住的人群和登山运动员红细胞和血红蛋白高于正常，即长期生活在高原地区的人群，其实验室检查结果会出现红细胞增多（E错）。